女，23岁，腹痛一周，发热2天，半月前使用药物流产并清宫。检查T38.8℃，R19次/分，BP135/90mmHg。妇科检查，宫颈光滑，宫口少量流液，子宫稍大有压痛。WBC13.8×10⁹/L，N0.8。该患者的治疗为
A. 中药治疗
B. 手术治疗
C. 抗感染治疗
D. 输液治疗
E. 物理降温

正确答案：C。抗感染治疗

解析：女，23岁，腹痛一周，发热2天，半月前使用药物流产并清宫。检查T38.8℃，感染的表现，诊断为子宫内膜炎，主要为抗生素药物治疗即抗感染。抗生素治疗可清除病原体，改善症状及体征，减少后遗症（C对）。手术治疗：主要用于抗生素控制不满意的输卵管卵巢脓肿或盆腔脓肿（B错）。中药治疗，输液治疗，物理降温均属于支持治疗，不是主要治疗。（ADE错）